肾是泌尿系统功能的主要执行者。位于腹膜后，其周围有被膜保护，具有产生尿液及重要的内分泌功能。下列叙述中，错误的是
A. 肾大盏约有2~3个
B. 肾盂由肾大盏汇合而成
C. 肾盂和输尿管的起始段位于肾窦内
D. 包绕在肾乳头周围的是肾小盏
E. 肾柱位于肾锥体间

正确答案：C。肾盂和输尿管的起始段位于肾窦内

解析：位于肾窦内的为肾盂（C错，为本题正确答案），肾盂离开肾窦后移行为输尿管。肾小盏（D对）承接肾乳头的尿液后汇合为肾大盏，2 ~3 个肾大盏（A对）再汇合成肾盂（B对）。肾柱为伸入肾锥体之间的肾皮质（E对）。